选择悬吊牵引治疗的是
A. 肩关节脱位
B. 儿童锁骨青枝骨折
C. 神经根型颈椎病
D. 桡骨头半脱位
E. 桡骨头远端骨折

正确答案：C。神经根型颈椎病

解析：选择悬吊牵引治疗的是神经根型颈椎病（C对）。肩关节脱位一般手法复位，用三角巾固定（A错）。儿童锁骨青枝骨折可仅用三角巾固定（B错）。桡骨头半脱位一般手法复位（D错）。桡骨头远端骨折的治疗是选择手法复位，石膏固定（E错）。